适用于膀胱过度兴奋引起的尿频、尿急或紧迫性尿失禁症状治疗的药物是
A. 托特罗定
B. 托拉塞米
C. 度他雄胺
D. 坦洛新
E. 西地那非

正确答案：A。托特罗定

解析：本题考查托特罗定。适用于膀胱过度兴奋引起的尿频、尿急或紧迫性尿失禁症状治疗的药物是托特罗定（A对）。托拉塞米（B错）为袢利尿药，临床用于充血性心力衰竭引起的水肿，肝硬化腹水，肾脏疾病所致水肿，原发性高血压。度他雄胺（C错）为5α-还原酶抑制剂，适用于治疗良性前列腺增生症（BPH）的中、重度症状，也用于中、重度症状的良性前列腺增生症患者，降低急性尿潴留（AUR）和手术的风险。坦洛新（D错）用于因前列腺增生所致的排尿障碍等症状，如尿频，夜尿增多、排尿困难等，另外肾功能不全者禁用。西地那非（E错）为选择性5型磷酸二酯酶抑制剂，主要用于治疗男性勃起功能障碍。